大规模研究试验显示，近年上市的环氧化酶-2抑制剂中，可增加心血管不良反应风险的药品是
A. 酮康唑
B. 洛伐他汀
C. 罗非昔布
D. 利血平
E. 阿昔洛韦

正确答案：C。罗非昔布

解析：本题考查药物的不良反应。罗非昔布（C对）属于昔布类选择性COX-2抑制剂，大剂量服用使患心肌梗死和心脏猝死的危险增加3倍。酮康唑（A错）不良反应主要有恶心、呕吐。洛伐他汀（B错）不良反应主要为肌炎。利血平（D错）属于交感神经末梢抑制剂，大剂量使用可出现抑郁症。阿昔洛韦（E错）为抗疱疹病毒药，不良反应少。